对次生环境描述不正确的是
A. 是指人类活动影响下形成的环境
B. 与原生环境相比，其中物质的交换、迁移和转化，能量信息的传递等都发生了重大的变化
C. 次生环境比原生环境差
D. 人类活动时不重视物质、能量平衡，就会使次生环境的质量变劣
E. 大量砍伐森林等人类活动将使次生环境质量日趋恶化

正确答案：C。次生环境比原生环境差

解析：本题考查次生环境。次生环境是指受人为活动影响形成的环境（A对）。人类在改造自然环境和开发利用自然资源的过程中，为自身的生存和发展提供了良好物质生活条件。原生环境是指天然形成的未受或少受人为因素影响的环境。次生环境要比原生环境好（C错，为本题正确答案），与原生环境相比，次生环境中物质的交换、迁移和转化，能量信息的传递等都发生了重大的变化（B对）。但人类在改造自然环境的同时也对原生环境施加了一定的影响。如果人类活动时不重视物质、能量平衡，就会使次生环境的质量变劣（D对）。大量砍伐森林等人类活动也将使次生环境质量日趋恶化（E对）。